足厥阴经与足太阴脾经循行交叉，变换前的位置，是在
A. 外踝上8寸处
B. 内踝上2寸处
C. 内踝上3寸处
D. 内踝上5寸处
E. 内踝上8寸处

正确答案：E。内踝上8寸处

解析：本题考查经脉的走行，属于记忆内容。下肢内侧，内踝尖上八寸以下为厥阴在前，太阴在中，少阴在后；内踝尖上八寸（E对）以上则太阴在前，厥阴在中，少阴在后。